频数分布的两个重要特征是
A. 统计量与参数
B. 样本均数与总体均数
C. 集中趋势与离散趋势
D. 样本标准差与总体标准差
E. 样本与总体

正确答案：C。集中趋势与离散趋势

解析：本题考查的是频数分布表的相关内容。从原始数据到整理后的数据，我们可从频数分布表得出数据的分布形态、集中位置、变异程度（C对ABDE错）等整体概貌特征。